治疗阿米巴病的首选药
A. 磺胺类
B. 头孢类
C. 甲硝唑
D. 红霉素类
E. 喹诺酮类

正确答案：C。甲硝唑

解析：甲硝唑临床主要用于治疗厌氧菌引起的口腔、腹腔、女性生殖器、下呼吸道、骨和关节等部位的感染。对幽门螺杆菌感染的消化性溃疡以及四环素耐药艰难梭菌所致的假膜性肠炎有特殊疗效。亦是治疗阿米巴病、滴虫病和破伤风的首选药物。掌握“磺胺类及甲硝唑”知识点。